公民对行政机关作出的行政决定不服欲申请行政复议，应当满足的条件包括
A. 应当有明确的被申请人
B. 经行政机关组织听证
C. 不属于人民法院管辖范围
D. 应有具体的复议请求和事实根据
E. 应在规定的申请时效内提起复议申请

正确答案：A、D、E。应当有明确的被申请人；应有具体的复议请求和事实根据；应在规定的申请时效内提起复议申请

解析：本题考查申请行政复议需满足条件。行政复议申请符合下列规定的，应当予以受理：①有明确的申请人和符合规定的被申请人（A对）；②申请人与具体行政行为有利害关系；③有具体的行政复议请求和理由（D对）；④在法定申请期限内提出（E对）；⑤属于行政复议法规定的行政复议范围；⑥属于收到行政复议申请的行政复议机构的职责范围；⑦其他行政复议机关尚未受理同一行政复议申请，人民法院尚未受理同一主体就同一事实提起的行政诉讼。